药物分子9位氟原子增加了抗炎活性，16位羟基降低9位氟原子带来的钠潴留副作用，将此羟基和17位羟基与丙酮生成缩酮，改善了药物动力学性质。该具有缩酮结构的药物是
A. 氢化泼尼松
B. 曲安西龙
C. 曲安奈德
D. 地塞米松
E. 氢化可的松

正确答案：C。曲安奈德

解析：本题考查具有缩酮结构的药物。曲安奈德（C对）具有缩酮结构。在糖皮质激素6α-和9α-位引入氟原子后，可使糖皮质激素的活性显著增加，但单纯的在9α-引入氟原子的皮质激素，其抗炎活性和钠潴留副作用会同时增加，无实用价值。后发现在9α-位引入氟原子同时再在其它部位进行修饰，如在9α-位引入氟原子、C16引入羟基并与C17α-羟基一道制成丙酮的缩酮，可抵消9α-氟原子取代增加钠潴留作用，糖皮质激素作用大幅度增加。曲安西龙（B错）没有缩酮结构。地塞米松（D错）分子中的16位为甲基，使抗炎活性增加，钠潴留作用减少，21位为羟基，该羟基可以与磷酸或琥珀酸成脂，进一步与碱金属成盐。天然存在的糖皮质激素是可的松和氢化可的松（E错），可的松和氢化可的松的1位增加双键分别得到泼尼松和氢化泼尼松（A错）。